肺心病肺动脉高压形成的多项因素中，可经治疗后明显降低肺动脉压的是
A. 慢支所致血管炎
B. 缺氧性肺血管收缩
C. 肺气肿压迫毛细血管
D. 慢性缺氧所致肺血管重建
E. 肺泡壁破裂所致肺循环阻力增大

正确答案：B。缺氧性肺血管收缩

解析：肺血管收缩在低氧性肺动脉高压的发生中起着关键作用，缺氧、高碳酸血症和呼吸性酸中毒使肺血管收缩、痉挛，其中缺氧是肺动脉高压形成最重要的因素，缺氧时收缩血管的活性物质增多，使肺血管收缩，阻力增加。因此纠正缺氧，舒张肺血管可明显降低肺动脉压（B对）。慢支所致血管炎（A错）、肺气肿压迫毛细血管（C错）、慢性缺氧所致肺血管重建（D错）、肺泡壁破裂所致肺循环阻力增大（E错）均为肺血管阻力增加的解剖学因素，对肺动脉高压的形成不起主要作用，经治疗后不能明显降低肺动脉压。